女，40岁。当听到家中房子因洪水倒塌的消息后，突然顿足哭喊，表情恐惧而紧张，砖头打砸旁边的房子，反复喊叫“我没有房子啦，我没有房子啦……”，1天后开始逐渐恢复平静。该患者最可能的诊断是
A. 分离（转换）性障碍
B. 创伤后应激障碍
C. 急性应激障碍
D. 急性短暂性精神病性障碍
E. 适应障碍

正确答案：C。急性应激障碍

解析：中年女性患者，有遭受到急剧、严重的精神创伤性事件的病史，表现为一过性的应激反应，综合患者的症状、体征，初步诊断为急性应激障碍（C对）。分离（转换）性障碍（A错）是一类复杂的心理－生理紊乱过程，表现在感知觉、情感、行为、自我（身份）意识及环境意识等方面的失整合，即所谓的分离状态。创伤后应激障碍（B错）长期持续存在。急性短暂性精神病性障碍（D错）的特点是既往精神状况正常的个体在没有任何前驱期症状的情况下急性起病，在两周内达到疾病的顶峰状态，并通常伴有社会和职业功能的急剧恶化。适应障碍（E错）不出现精神病性症状。